ADH可以调节
A. 近曲小管对水的重吸收
B. 髓袢降支粗段对水的重吸收
C. 髓袢细段对水的重吸收
D. 髓袢升支粗段对水的重吸收
E. 远曲小管和集合管对水的重吸收

正确答案：E。远曲小管和集合管对水的重吸收